光化学烟雾是由下列哪些环境污染物在强烈的太阳紫外线作用下，发生光化学反应而形成的一种浅蓝色烟雾
A. H₂S、CO
B. CO₂、NOₓ
C. NOₓ、烃类
D. 烃类、醛类
E. 醛类、酮类

正确答案：C。NOₓ、烃类

解析：NOx、烃类在强烈日光紫外线照射下，经过一系列光化学反应而生成的浅蓝色烟雾（C对），成分主要是臭氧、过氧酰基硝酸酯、醛类、酮类、过氧化氢等。